男，20岁，平素健康，淋雨后，突发寒战高热、头痛。第2天出现右侧胸痛、咳嗽、咳痰，胸片示右上肺大片实变影。最可能诊断为
A. 大叶性肺炎
B. 胸膜增厚
C. 肺脓肿
D. 肺结核
E. 肺梗死

正确答案：A。大叶性肺炎

解析：患者为青年男性（大叶性肺炎的好发人群），淋雨后出现寒战、高热、头痛，第2天出现右侧胸痛咳嗽咳痰，胸片示右上肺大片实变影（为大叶性肺炎的典型表现），根据其临床表现和影像学检查结果，考虑诊断为大叶性肺炎（A对）。胸膜增厚（B错）主要表现胸痛或呼吸困难等症状，胸片一般无肺实变影。肺脓肿（P58）（C错）临床特征为高热、咳嗽、咳大量脓臭痰，胸部X线影像显示有一个或多发的含气液平的空洞。肺结核（P65）（D错）常有咳嗽、咳痰或咯血，并有长期午后潮热、乏力、盗汗及消瘦等结核中毒症状，胸片见病变多在肺尖或锁骨上下，密度不匀，消散缓慢，且可形成空洞或肺内播散。肺梗死（P99）（E错）可有发热，但多为低热，主要表现为突发胸痛和呼吸困难等症状。